余邪留伏阴分的热型是
A. 日晡潮热
B. 发热夜甚
C. 夜热早凉
D. 身热不扬
E. 长期低热

正确答案：C。夜热早凉

解析：人体卫气日行于阳，夜行于阴，余邪留于阴分，卫气夜入阴分与邪相争，故夜热；天明卫气行于阳，不与邪争，故早凉（C对）。